关于匹配的目的，下列叙述错误的是
A. 平衡配比因素对病例组和对照组的影响
B. 平衡混杂因素对病例组和对照组的影响
C. 控制混杂因素对研究结果的影响
D. 提高研究效率
E. 消除已知混杂因素对研究结果的影响

正确答案：E。消除已知混杂因素对研究结果的影响